胃痛的病机是
A. 胃失和降，逆气动膈
B. 胃失和降，胃气上逆
C. 胃气阻滞，胃失和降
D. 脾胃虚寒，胃中无火
E. 痰瘀互结，食道狭窄

正确答案：C。胃气阻滞，胃失和降

解析：胃失和降，逆气动膈为呃逆的病机（A错）。胃失和降，胃气上逆为呕吐的病机（B错）。胃痛多因外邪犯胃、饮食伤胃、情志不畅和脾胃虚寒等，导致胃气郁滞，胃失和降，不通则痛，发为胃痛（C对）。脾胃虚寒，胃中无火为反胃的病机（D错）。痰瘀互结，食道狭窄为噎膈的病机（E错）。